以下情形不属于医疗机构承担赔偿责任的情形的是
A. 泄露患者隐私
B. 未尽到说明义务
C. 未尽到与当时医疗水平相应的诊疗义务
D. 违反法律、行政法规、规章以及其他有关诊疗规范的规定
E. 医务人员在诊疗过程当中尽到当时医疗水平相应的诊疗义务

正确答案：E。医务人员在诊疗过程当中尽到当时医疗水平相应的诊疗义务

解析：医疗机构承担赔偿责任的情形：①未尽到说明义务；②未尽到与当时医疗水平相应的诊疗义务；③泄露患者隐私。掌握“医疗损害责任”知识点。